由胰岛A细胞分泌的激素是
A. 胰岛素
B. 胰高血糖素
C. 生长抑素
D. 血管活性肠肽
E. 胰多肽

正确答案：B。胰高血糖素

解析：胰高血糖素（B对）由胰岛A细胞分泌。胰岛素（A错）由胰岛B细胞分泌。生长抑素（C错）由胰岛D细胞分泌。血管活性肠肽（D错）由胰岛H细胞分泌。胰多肽（E错）由胰岛PP细胞分泌。